患者男，24岁。病发热已五六天，热略减退，突然出现肢体软弱无力，步履艰难，心烦口渴，咳呛不爽，咽喉干燥，小便黄少，大便干燥，舌质红苔黄，脉细数。证属
A. 初期肺痈
B. 风热犯肺型喘证
C. 肺热津伤型痿证
D. 虚热型肺痿
E. 燥热咳嗽

正确答案：C。肺热津伤型痿证

解析：患者以突然出现肢体软弱无力为主诉，诊断为痿证。温热之邪犯肺，肺脏气阴受伤，津液不足以敷布全身，遂致筋脉皮肤失养而肢体痿软，步履艰难。热邪伤津，故心烦口渴、小便黄少、大便干燥。肺津不能上润肺系，故咽喉干燥、咳呛不爽。舌质红、苔黄、脉细数，均为阴伤津涸，虚热内炽之象，故诊断患者为肺热津伤型痿证（C对）。初期肺痈临床表现为发热恶寒，咳嗽，胸痛，咳时尤甚，咳白色黏痰或黏液脓性痰，痰量日渐增多，胸闷，呼吸不利，口干鼻燥，舌红，苔薄黄或薄白，脉浮数而滑（A错）。喘证无风热犯肺证型（B错）。虚热型肺痿的临床表现为咳吐浊唾，或咳痰带血，咳声不扬，甚则音嘎，气急喘促，口渴咽燥，可伴潮热盗汗，形体消瘦，皮毛干枯，舌红而干，脉虚数（D错）。燥热咳嗽症见身热头痛，干咳无痰，气逆而喘，咽干鼻燥，心烦口渴（E错）。